属于牵涉痛的情况
A. 胆囊炎患者Murphy征阳性
B. 阑尾炎患者麦氏点压痛阳性
C. 冠心病患者胸骨后疼痛
D. 右下肺炎患者右肩部疼痛
E. 肋间神经炎患者电击样痛

正确答案：D。右下肺炎患者右肩部疼痛

解析：牵扯（涉）痛，是指内脏性疼痛牵涉到身体体表部位，即内脏痛觉信号传至相应脊髓节段，引起该节段支配的体表部位疼痛。右下肺炎患者疼痛放射至右肩部（D对），属于牵涉痛。胆囊炎患者Murphy征阳性（A错）、阑尾炎患者麦氏点压痛阳性（B错）、冠心病患者胸骨后疼痛（C错）和肋间神经炎患者电击样痛（E错）都属于病变部位本身疼痛，不属于牵涉痛。